在细胞间或细胞与基质间起黏附作用的是
A. CD
B. CAM
C. CR1
D. CKR
E. FcR

正确答案：B。CAM